结膜
A. 与睑板及巩膜均紧密相连
B. 形成密闭的囊状腔隙
C. 不含血管
D. 为一层薄而透明的粘膜
E. 均不正确

正确答案：D。为一层薄而透明的粘膜

解析：结膜为一层薄而透明的黏膜（D对），富含血管（C错），分睑结膜，球结膜和结膜穹隆。睑结膜与睑板紧密相连，球结膜与巩膜紧密相连，而结膜穹窿连结疏松易移动，并非与睑板及巩膜均紧密相连（A错）。当上、下脸闭合时，整个结膜形成囊状腔隙，且经脸裂与外界相通（B错）。